房室瓣关闭主要是由于
A. 心房收缩
B. 心室收缩
C. 乳头肌收缩
D. 房-室压差下降
E. 心房压力下降

正确答案：B。心室收缩